根据研究目的确定的同质观察单位某种变量值的集合，称为
A. 总体
B. 定性数据
C. 变异
D. 同质
E. 样本

正确答案：A。总体

解析：总体是根据研究目的确定的同质观察单位某种变量值的集合。掌握“统计基本概念和步骤”知识点。